仰卧位时，腹膜腔最低的陷窝是
A. 肝肾隐窝
B. 盲肠后隐窝
C. 膀胱子宫陷凹
D. 直肠膀胱陷凹
E. 无

正确答案：A。肝肾隐窝

解析：肝肾隐窝（A对）在仰卧位时,是腹膜腔的最低部位，站立或坐位时,男性的直肠膀胱陷凹（D错）、女性的直肠子宫陷凹是腹膜腔的最低部位。